从感染后至症状出现前能排出病原体的人属于
A. 非典型病人
B. 潜伏期病原携带者
C. 恢复期病原携带者
D. 健康病原携带者
E. 所有带菌者

正确答案：B。潜伏期病原携带者

解析：本题考查潜伏期病原携带者。从感染后至症状出现前能排出病原体的人属于潜伏期病原携带者（B对AE错）。恢复期病原携带者（C错）指临床症状消失后仍能在一定时间内向外排出病原体的人，如乙型肝炎、伤寒、霍乱等。健康病原携带者（D错）指从未患过传染病，但能排出病原体的人。